关于12个月龄小儿的生长发育状况，正确的是
A. 体重是出生时的7倍
B. 身长为65厘米
C. 头围达40厘米
D. 会爬行、蹒跚学步
E. 乳牙尚未萌出

正确答案：D。会爬行、蹒跚学步

解析：本题考查体格生长发育的相关内容。10月龄之后多数婴儿已会爬行、蹒跚学步（D对）；12月龄时体重约为出生体重的3倍（A错）；1岁时约为出生时身长的1.5倍，即75～77cm（B错）；1岁时儿童的头围约为45～47cm（C错）；多数婴儿于10月龄时乳牙开始萌出（E错）。